前瞻性队列研究与历史性队列研究的主要不同点在于
A. 前者为随访研究，后者为横断面研究
B. 前者研究对象进入队列的时间是即时的，后者为过去的
C. 前者为由因及果的研究，后者为由果及因的研究
D. 前者设立对照组，后者不设对照
E. 前者有失访，后者没有

正确答案：B。前者研究对象进入队列的时间是即时的，后者为过去的

解析：本题考查队列研究种类的差别。前瞻性队列研究与历史性队列研究主要的不同点在于前者研究对象进入队列的时间是即时的，后者为过去的（B对ACDE错）。